下列关于“齐平末端”的叙述正确的是
A. 上、下颌第一乳磨牙的远中面彼此相齐，成一垂直平面
B. 上、下颌第二乳磨牙的远中面彼此相齐，成一垂直平面
C. 上、下颌第一磨牙的远中面彼此相齐，成一垂直平面
D. 上、下颌第二磨牙的远中面彼此相齐，成一垂直平面
E. 上、下颌第三磨牙的远中面彼此相齐，成一垂直平面

正确答案：B。上、下颌第二乳磨牙的远中面彼此相齐，成一垂直平面

解析：2.5～4岁期间的特征：牙排列紧密而无明显间隙；切缘及（牙合）面尚无显著磨耗；乳牙位置较正；覆（牙合）较深，覆盖较小，（牙合）曲线不明显；上、下颌第二乳磨牙的远中面彼此相齐，成一垂直平面称为齐平末端。掌握“（牙合）的生长发育”知识点。